营养肝和胆囊的血管来自
A. 肠系膜上动脉
B. 肠系膜下动脉
C. 脾动脉
D. 肝总动脉
E. 胃左动脉

正确答案：D。肝总动脉

解析：肝总动脉（D对）分出肝固有动脉分为肝左支和肝右支分布于肝，肝右支发出胆囊动脉分布于胆囊。